在乳牙龋病的修复治疗中的注意事项，说法错误的是
A. 乳磨牙的Ⅱ类洞的轴髓壁可制备成倾斜状
B. 邻面成形时应该使用楔子
C. 必须完整恢复缺失牙的外形
D. 乳牙外形恢复时不必勉强恢复接触点
E. 乳牙外形恢复不必拘泥于牙尖嵌合的程度

正确答案：C。必须完整恢复缺失牙的外形

解析：乳牙的牙颈部缩窄，磨牙（牙合）面颊舌径小，易磨耗。则在制备Ⅱ类洞时，轴髓壁作成倾斜状，避免意外露髓。使用楔子避免充填体在邻面形成悬突。乳牙表层釉质为无釉柱釉质，且有机质含量高，针对恒牙的粘结剂在乳牙应用可能会影响粘结效果。在乳牙的修复外形时也应考虑到生理间隙的特点，不必勉强恢复接触点，尽可能恢复原来的外形但不拘泥于牙尖嵌合的修复。在数个牙齿的牙冠崩坏，应注意恢复咬合高度即可。掌握“乳牙龋”知识点。